医院健康教育的目标人群（广义概念下的医院健康教育）为
A. 患者及其家属
B. 患者、家属及陪护人员、医护人员与职工、社区人群
C. 患者、家属及陪护人员
D. 患者及社区群众
E. 医护人员及社区人群

正确答案：B。患者、家属及陪护人员、医护人员与职工、社区人群